含维生素A原较高的食物是
A. 菠菜
B. 土豆
C. 冬瓜
D. 苹果
E. 四季豆

正确答案：A。菠菜